患者胸膈疼痛，食不得下而复吐，甚至水饮难下，大便坚如羊屎，面色晦滞，形体消瘦，舌红少津，脉细涩。其治法是
A. 滋阴养血，破结行瘀
B. 益气养阴，行气化痰
C. 养阴润燥，降气消导
D. 润燥行瘀，开郁化痰
E. 滋阴养血，散结化痰

正确答案：A。滋阴养血，破结行瘀

解析：题中患者诊断为噎膈的瘀血内结证，治宜破结行瘀，滋阴养血（A对）。益气养阴为气阴耗伤的治法，行气化痰为气滞痰阻的治法（B错）。养阴润燥，降气消导为津亏热结的治法（C错）。润燥行瘀，开郁化痰，为痰气交阻的治法（D错）。滋阴养血为阴血亏虚的治法，散结化痰为痰阻气滞的治法（E错）。